沙丁胺醇
A. 选择性激动β₁受体
B. 选择性激动β₂受体
C. 对β₁和β₂受体都有激动作用
D. 对β受体作用很弱
E. 对α、β₁和多巴胺受体都有激动作用

正确答案：B。选择性激动β₂受体

解析：本题考查沙丁胺醇。沙丁胺醇是常用的选择性的短效β₂受体激动剂（B对），支气管扩张作用明显，对心脏β₁受体激动作用较弱。临床上用于缓解支气管哮喘、哮喘型支气管炎和肺气肿患者的支气管痉挛性急性症状。选择性激动β₁受体（A错）的药物是多巴酚丁胺。对β₁和β₂受体都有激动作用（C错）的药物是异丙肾上腺素。对α、β₁和多巴胺受体都有激动作用（E错）的药物是多巴胺。